抑郁症睡眠特征性
A. 浅多梦
B. 入睡困难
C. 睡眠过多
D. 早醒
E. 唤醒困难

正确答案：D。早醒

解析：抑郁症睡眠特点为早段失眠（入睡困难）、中段失眠（睡眠轻浅、多梦）和末段失眠（早醒）,其中以早醒最具有特征性（D对）。